有明显神经精神症状的营养性巨幼细胞性贫血，应首选的治疗药物是
A. 右旋糖酐铁
B. 维生素C
C. 硫酸亚铁
D. 维生素B₁₂
E. 叶酸

正确答案：D。维生素B₁₂

解析：营养性巨幼细胞性贫血是由于叶酸或VitB₁₂缺乏导致的血红蛋白合成障碍引起的贫血，有明显神经精神症状者提示有维生素B₁₂缺乏，仅补充叶酸虽可纠正叶酸缺乏引起的贫血，但对于有维生素B₁₂缺乏导致的明显神经精神症状者无效，应首选维生素B₁₂治疗（D对E错）。右旋糖酐铁（A错）、硫酸亚铁（C错）是缺铁性贫血的治疗药物；维生素C（B错）可促进铁剂吸收。